股骨颈头下型骨折最易并发
A. 缺血性骨坏死
B. 创伤性骨关节炎
C. 创伤性骨化
D. 坐骨神经损伤
E. 关节僵硬

正确答案：A。缺血性骨坏死

解析：股骨头血液供应来源有小凹动脉、股骨干滋养动脉升支和旋股内、外侧动脉。旋股内侧动脉又可分为骺外侧动脉、干骺端上侧动脉、干骺端下侧动脉，其中骺外侧动脉供应股骨头2/3～4/5区域的血液循环，是股骨头最主要的供血来源。股骨头下骨折时，股骨头的主要供血动脉（骺外侧动脉）中断，使股骨头严重缺血，因此容易发生股骨头缺血性坏死（A对）。创伤性关节炎（B错）是关节内骨折愈合后不平整的关节面相互摩擦损伤而发生的关节炎，而非股骨颈头下型骨折后常见并发症。创伤性骨化（C错）多见于如肱骨髁上骨折所致的肘关节损伤。坐骨神经损伤（D错）可见于骨盆骨折、髋关节后脱位等。关节僵硬（E错）好发于骨折后长期制动的患者。